女性，55岁。丧偶8年，现独居，嗜烟酒，不爱运动。平时性情抑郁，过分容忍，办事无主见，常顺从于别人。1月前行胃癌切除，术中及术后情绪低落，兴趣下降，常独自流泪，有轻生之念。对这种病人临床上应采取哪种措施
A. 支持性心理治疗
B. 认知疗法
C. 精神分析疗法
D. 药物治疗
E. 以上都是

正确答案：E。以上都是